蛔虫病是儿童期常见的寄生虫病，对所有学生进行集体驱蛔的适应证是
A. 学生蛔虫感染率在20%以上
B. 学生蛔虫感染率在30%以上
C. 学生蛔虫感染率在40%以上
D. 学生蛔虫感染率在50%以上
E. 学生蛔虫感染率在60%以上

正确答案：C。学生蛔虫感染率在40%以上